通常不存在于RNA中的碱基是
A. I
B. X
C. A
D. T
E. U

正确答案：D。T